影响牙周炎预后的因素不包括
A. 牙周袋深度
B. 牙槽骨吸收程度
C. 牙髓炎症
D. 根分叉病变程度
E. 菌斑控制的情况

正确答案：C。牙髓炎症

解析：本题考查影响牙周炎预后的因素。牙髓炎症（C错，为本题正确答案）属于牙髓组织疾病，牙周炎属于牙周组织疾病，牙周炎的预后和牙髓炎症无关。牙周炎病损涉及范围除牙龈组织外，还包括牙槽骨、牙周膜及牙骨质，表现为表层的牙龈及深层的牙周支持组织炎症和破坏，破坏程度不一，导致牙周炎的预后不同。影响牙周炎预后的因素有：牙槽骨吸收程度（B对），牙槽骨吸收过多时，即使终止病变继续进行，但已吸收造成的牙槽骨量不足，使得患牙周炎的牙齿无法保留，影响牙周炎预后；牙周袋深度（A对），过深牙周袋及严重的附着丧失，使得牙齿和牙槽骨之间牙周膜丧失，没有了牙周膜纤维束的悬吊作用，也会影响牙周炎预后；根分叉病变程度（D对）也会影响牙周炎的预后，严重的根分叉病变，会导致根分叉部位暴露，预后不佳；菌斑和牙石是牙周炎的始动因子，菌斑的控制情况（E对），会影响牙周炎的预后，菌斑控制的好预后好。